药典一部收载的药有
A. 药材
B. 饮片
C. 提取物
D. 成方制剂
E. 单味制剂

正确答案：A、B、C、D、E。药材；饮片；提取物；成方制剂；单味制剂

解析：本题考查药典一部的主要内容。药典一部收载的药有药材（A对）、饮片（B对）、提取物（C对）、成方制剂（D对）、单味制剂（E对）。《中华人民共和国药典）（2015年版）简称《中国药典》《药典》，由一部、二部、三部、四部组成。药典一部收载药材及饮片、植物油脂和提取物、成方制剂和单味制剂等；药典二部收载化学药品、抗生素、生化药品、放射性药品等；药典三部收载生物制品；药典四部为通则和药用辅料。